口腔颌面部损伤的“二次弹片伤”是指
A. 多于两块的弹片损伤口腔颌面部
B. 颌面损伤伴牙损伤，折断的牙碎片向邻近组织内飞散
C. 口腔颌面部受到2次弹片打击所造成的损伤
D. 弹片损伤涉及两个部位
E. 骨折致牙列变形、咬合错乱、面部畸形

正确答案：B。颌面损伤伴牙损伤，折断的牙碎片向邻近组织内飞散

解析：本题考查口腔颌面部损伤的“二次弹片伤”。在火器伤时，被击碎的牙碎片向邻近组织内飞溅（B对），并可将附着于牙上的结石和细菌等带入深部组织引起创口感染，称为二次弹片伤，是口腔颌面部创伤的特点之一。